咬合创伤可表现为
A. 牙槽骨水平吸收
B. 不对称性龈退缩和龈裂
C. 形成假性牙周袋
D. 牙龈重度炎症
E. 咬合运动时牙龈发红

正确答案：B。不对称性龈退缩和龈裂

解析：本题考查（牙合）创伤的临床指证。咬合创伤可表现为不对称性龈退缩和龈裂（B对）。咬合创伤会使牙齿松动，可表现为不对称性龈退缩和龈裂；松动严重的牙，当咬合时该牙牙龈受压迫会变苍白而不是发红（E错）。咬合创伤引起的常为牙槽骨垂直吸收，形成骨下袋，是真性牙周袋（C错）；而炎症则多引起水平吸收（A错）。单纯的（牙合）创伤不会引起或加重牙龈的炎症，当伴有严重的牙周炎症或明显的局部刺激因素，会加重牙周袋和牙槽骨吸收，所以牙龈重度炎症（D错）不是咬合创伤的表现。